配制下列化疗药时，只能选择葡萄糖注射液做溶媒的是
A. 环磷酰胺
B. 博来霉素
C. 依托泊苷
D. 奥沙利铂
E. 顺铂

正确答案：D。奥沙利铂

解析：本题考查奥沙利铂。只能选择葡萄糖注射液做溶媒的是奥沙利铂（D对）。奥沙利铂与氯化钠注射液生成二氯二氨铂，使疗效降低。根据药性选用溶剂：用葡萄糖注射液作溶剂的有吡柔比星、卡铂、奥沙利铂；用氯化钠注射液作溶剂的有环磷酰胺（A错）、博来霉素（B错）、喜树碱、亚胺醌、依托泊苷（C错）、顺铂（E错）。